患者，男，50岁。半天来呕血4次，量约1200mL，黑便2次，量约600g，伴头晕心悸。查体：血L压80/60mmHg，心率118次/分，神志淡漠，巩膜轻度黄染，腹部膨隆，移动性浊音（﹢），应首先采取的措施是
A. 等待输血
B. 配血，快速输液，等待输血
C. 紧急胃镜检查明确出血部位
D. 诊断性腹腔穿刺，明确腹水性质
E. 急查血细胞比容

正确答案：B。配血，快速输液，等待输血

解析：中年男性患者，半天来呕血4次黑便2次，诊断为急性上消化道出血，出血量超过1000mL，伴头晕心悸，查体：血压80/60mmHg，心率118次/分，神志淡漠，提示周围循环衰竭，应紧急配血，快速输液，等待输血，扩充血容量（B对）。